青光眼病人的眼压约在22～42mmHg范围，非青光眼病人的眼压约在14～26mmHg范围内，根据这些资料，可以认为：采用两项筛检试验串联使用，可以使筛检试验的哪一特征增加
A. 灵敏度增加
B. 特异度增加
C. 领先时间增加
D. 阴性预测值增加
E. 患病率增加

正确答案：B。特异度增加

解析：本题考查提高筛检收益的方法。串联试验也称系列试验，即一组筛检试验按一定的顺序相连，初筛阳性者进入下一轮筛检，全部筛检试验结果均为阳性者才定为阳性。采用两项筛检试验串联使用，可以使筛检试验的特异度增加（B对ACDE错）。